接基层医疗单位疫情报告，称某地伤寒暴发，流行病医生到现场首要的工作是
A. 确定首发病例时间
B. 追踪传染源
C. 隔离传染源
D. 迅速查明暴发因素
E. 以上都不是

正确答案：E。以上都不是

解析：本题考查暴发调查的步骤。当接到基层医疗单位疫情报告，称某地伤寒暴发，流行病医生到现场首要的工作是根据临床特征，结合实验室检查判断暴发信息的确凿性（E对ABCD错）。